成人高血压的诊断标准是
A. BP≥140/90mmHg
B. BP≥150/90mmHg
C. BP≥160/90mmHg
D. BP≥160/95mmHg
E. BP≥165/95mmHg

正确答案：A。BP≥140/90mmHg